实行新成员上岗前教育使之形成制度，长期坚持不懈的是
A. 上岗前医德培训
B. 医务人员行为规范
C. 医德考核结果
D. 技术考核结果
E. 文明礼貌服务

正确答案：A。上岗前医德培训

解析：中华人民共和国医务人员道德规范及实施办法 第六条 医德教育应以正面教育为主，理论联系实际，注重实效，长期坚持不懈。要实行医院新成员的上岗前教育，使之形成制度。未经上岗前培训不得上岗（A对）。